化脓性脑膜炎合并硬膜下积液，常见的病原菌是
A. 金黄色葡萄球菌
B. 大肠杆菌
C. B族溶血性链球菌
D. 流感嗜血杆菌
E. 绿脓杆菌（铜绿假单胞菌）

正确答案：D。流感嗜血杆菌

解析：化脓性脑膜炎合并硬膜下积液常见的病原菌（八年制儿科学第二版P413）是流感嗜血杆菌（D对）或肺炎链球菌。金黄色葡萄球菌（A错）、大肠杆菌（B错）、B族溶血性链球菌（C错）、绿脓杆菌（铜绿假单胞菌）（E错）不常见于化脓性脑膜炎合并硬膜下积液。